下列哪项不是急性肾炎的临床特征
A. 多数病人都有血尿
B. 病程早期常有高血压
C. 部分病例可出现急性肾功能不全
D. 血压急剧升高时可出现高血压脑病
E. 浮肿为可凹性，上行性

正确答案：E。浮肿为可凹性，上行性

解析：血尿常为急性肾炎的起病的首发症状和就诊原因，几乎所有的患者都有血尿（A对）。高血压见于80%左右的病例，多为轻中度高血压（B对）。急性肾功能不全是急性肾炎死亡的主要原因，表现为少尿、无尿，血肌酐、尿素氮升高，以及高血钾、代谢性酸中毒等尿毒症症状（C对）。高血压脑病儿童患者多见，表现为剧烈头痛、呕吐、嗜睡、神志不清、黑蒙，严重者有阵发性惊厥及昏迷。常因此而掩盖了急性肾炎本身表现，可与高血压同时存在（D对）。水肿常为起病的早期症状，80%以上的患者出现水肿。典型表现为先有晨起眼睑水肿然后伴有下肢轻度指凹性水肿，严重的波及全身，不是上行性的（E错，为本题正确答案）。